促红细胞生成素的作用是促进
A. 铁的吸收
B. 晚期红系祖细胞增殖、分化
C. 维生素B₁₂的吸收
D. 成熟红细胞释放入血
E. 雄激素的释放

正确答案：B。晚期红系祖细胞增殖、分化

解析：促红细胞生成素（EPO）主要在肾合成，缺氧时即释放入血，晚期红系祖细胞是EPO作用的主要靶细胞，EPO可同原始红细胞和红系集落形成单位相互作用，促使它们繁殖和分化（B对），加速有核红细胞的成熟以及血红素和Hb的合成。